对某饭店进行食品卫生检查，下列哪一项不符合卫生要求
A. 动物性食品和蔬菜分池清洗
B. 盛放生、熟食品的容器分开并有明显标记
C. 冰箱内熟食品放上层，生食品放下层
D. 冰箱内有私人药品，但分开存放
E. 木耳等干菜未放进冰箱储存

正确答案：D。冰箱内有私人药品，但分开存放